社区口腔卫生服务对象是
A. 城镇居民
B. 乡村居民
C. 国家人民
D. 社区居民
E. 社会

正确答案：D。社区居民

解析：社区口腔卫生服务是以社区为范围，以需求为导向，以社区居民为对象，以解决社区主要口腔卫生问题。掌握“社区口腔卫生服务”知识点。